阳虚证最主要的症状是
A. 大便稀溏
B. 口淡不渴
C. 无汗或少汗
D. 面色淡白
E. 形寒肢冷

正确答案：E。形寒肢冷

解析：阳虚证的证候表现为畏寒，肢冷，小便清长或尿少浮肿，大便稀薄，口淡不渴，或喜热饮，或自汗，面色㿠白，舌淡胖，苔白滑，脉沉迟无力。但由于阳气首先是温养的作用，故阳虚首先表现为形寒肢冷（E对ABCD错）。